在前瞻性队列调查中，确定人群分组方法是
A. 按发病者与未发病者分
B. 按年龄，性别，职业，生活条件相同而发病情况不同分组
C. 按不同家族史分组
D. 按暴露于某因素和未暴露于某因素分组
E. 按随机方法

正确答案：D。按暴露于某因素和未暴露于某因素分组

解析：本题考查前瞻性队列研究的分组。在前瞻性队列研究中，研究人员按暴露于某因素和未暴露于某因素对人群进行分组（D对ABCE错）。